手部创口清创处理，一般不迟于
A. 8小时
B. 9小时
C. 10小时
D. 11小时
E. 12小时

正确答案：A。8小时

解析：手部创口为开放性伤口，常有污染，应行清创术，目的是将污染伤口变成清洁伤口，为组织愈合创造良好条件。清创时间越早越好，伤后6～8小时内（A对BCDE错）清创一般都可达到一期愈合。如果是手部断肢再植的话，时间也应严格控制在6～8小时以内，以防再灌注损伤引起全身毒性反应。